根据《传染病学防治法》，属于乙类传染病学的是
A. 鼠疫
B. 麻风病
C. 百日咳
D. 流行性感冒
E. 流行性腮腺炎

正确答案：C。百日咳

解析：根据《传染病学防治法》，属于乙类传染病学的是百日咳（C对）。鼠疫属于甲类传染病（A错）。麻风病是丙类传染病（B错）。流行性感冒是丙类传染病（D错）。流行性腮腺炎丙类传染病（E错）。